利用电热或红外线烤箱高热烘烤进行灭菌的方法属于
A. 煮沸消毒法
B. 化学消毒法
C. 干热灭菌法
D. 医用酒精消毒法
E. 高压蒸汽灭菌

正确答案：C。干热灭菌法

解析：干热灭菌法：利用电热或红外线烤箱高热烘烤进行灭菌。适用于玻璃、陶瓷等器具，以及不宜用高压蒸气灭菌的明胶海绵、凡士林、油脂、液体石蜡和各种粉剂等物品。不耐高热的物品，如棉织品、合成纤维、塑料及橡胶制品等，不可用此法灭菌。干热灭菌的温度和维持时间应根据消毒物品导热快慢、包装大小和安放情况而定。掌握“口外消毒和灭菌”知识点。